非处方药布洛芬，不适用于
A. 感冒、流感的解热
B. 中度的关节痛
C. 胃酸过多、烧心
D. 头痛、牙痛、肌肉痛
E. 神经痛和痛经

正确答案：C。胃酸过多、烧心

解析：本题考查布洛芬。非处方药布洛芬，不适用于胃酸过多、烧心（C错，为本题正确答案）。胃酸分泌过多、烧心可用碳酸氢钠、氢氧化铝来缓解。布洛芬是非甾体抗炎药的一种，适用于解热（A对）、减轻轻度至中度疼痛，如关节痛（B对）、牙痛、肌肉痛、头痛（D对）、偏头痛、神经痛、痛经（E对）、感冒及流感症状。主要的优点是胃肠道不良反应较轻。